不合理用药的后果有
A. 延误疾病治疗
B. 浪费医药资源
C. 产生药物不良反应
D. 造成病人死亡
E. 产生药源性疾病

正确答案：A、B、C、D、E。延误疾病治疗；浪费医药资源；产生药物不良反应；造成病人死亡；产生药源性疾病